继发性肝癌确诊的关键是
A. 超声检查
B. CT检查
C. 磁共振成像（MRI）
D. 放射性核素肝扫描
E. 病理检查和找到肝外原发癌的证据

正确答案：E。病理检查和找到肝外原发癌的证据